与义齿吸附力无关的因素是
A. 基托材料
B. 唾液质量
C. 基托与黏膜的密合度
D. 基托与黏膜的接触面积
E. 不同分子之间的吸引力

正确答案：A。基托材料

解析：本题考查全口义齿固位及稳定。基托材料（A错，为本题正确答案）与义齿吸附力无关。吸附力：吸附力是两种物体分子之间相互的吸引力，包括附着力和内聚力。附着力是指不同种分子之间的吸引力（E对）。内聚力是指同种分子之间的内聚力。全口义齿的基托组织面和黏膜紧密贴合，其间有一薄层的唾液，基托组织面与唾液，唾液与黏膜之间产生了附着力，唾液本身分子之间产生内聚力（粘结力），而使全口义齿获得固位。吸附力的大小与基托和黏膜之间的接触面积（D对）、密合程度（C对）有关系。接触面积越大越密合，其吸附力也就越大。吸附力的大小还和唾液的质和量有关系（B对），如果唾液的黏稠度高，流动性小，可以加强附着力和内聚力，而增强义齿的固位。相反，如果唾液的黏稠度低，流动性大，则可减低固位作用。